以下不属于心理健康的意义的是
A. 有助于心理疾病的防治
B. 有助于心理健康的发展
C. 有助于推动精神文明的建设
D. 心理健康事业是精神文明建设的重要组成部分
E. 一般而言，心理不健康者的学习状态优于心理健康者

正确答案：E。一般而言，心理不健康者的学习状态优于心理健康者